通过有组织的社会努力，预防口腔疾病，维护口腔健康和提高生命质量的科学与艺术是以下哪项的内容
A. 口腔解剖学
B. 口腔流行病学
C. 口腔预防医学
D. 口腔统计学
E. 口腔修复学

正确答案：C。口腔预防医学

解析：本题考查口腔预防医学的定义。通过有组织的社会努力，预防口腔疾病，维护口腔健康和提高生命质量的科学与艺术是口腔预防医学（C对）的内容。它以人群为主要研究对象，应用生物学、环境医学、预防医学、临床医学及社会医学的理论，宏观与微观相结合的方法，研究口腔健康及其影响因素、预防口腔疾病的措施及对策，达到预防口腔疾病，促进口腔健康及提高生命质量的目的，是口腔医学的一门分支学科和组成部分。口腔解剖学（A错）是一门以研究口腔、颅、面、颈部诸部位的正常形态结构、功能活动规律及其临床应用特点为主要内容的学科。口腔流行病学（B错）是流行病学的一个分支，即用流行病学的原则、基本原理和方法，研究人群中口腔疾病的发生、发展和分布的规律及其影响因素，同时研究口腔健康及其影响因素为探讨口腔疾病的病因、流行因素，制定口腔保健计划，选择防治策略和评价服务效果打下良好基础。口腔统计学（D错）是统计学的一个分支。口腔修复学（E错）是应用符合生理的方法，采用人工装置修复口腔及颌面部各种缺损并恢复其相应功能，预防或治疗口颌系统疾病的一门临床科学。